麻醉药品进出库执行
A. 质量审核制度
B. 复核制度
C. 不合格药品管理制度
D. 双人收发货制度
E. 色标管理

正确答案：D。双人收发货制度

解析：本题考查双人双锁管理制度。麻醉药品进出库执行双人收发货制度（D对）。麻醉药品和第一类精神药品入出库实行双人核查制度，药品入库须双人验收，出库须双人复核，做到账、物相符。